闭合性肋骨骨折的治疗要点是
A. 止痛、防治并发症
B. 胸腔穿刺
C. 胸腔闭式引流
D. 开胸探查
E. 气管插管或气管切开

正确答案：A。止痛、防治并发症

解析：闭合性肋骨骨折治疗以有效镇痛、防止并发症为主（A对）。有效镇痛可增加病人的肺活量、肺顺应性，降低气道阻力和胸壁的反常运动，改善肺功能，防治肺部并发症，促进患者早日康复。胸腔穿刺（B错）主要用于胸腔积液和气胸的诊断和治疗。胸腔闭式引流（C错）主要用于血、气胸的治疗。开胸探查（D错）适用于进行性血胸、心脏大血管损伤等胸部严重损伤的患者。气管插管或气管切开（E错）用于咳嗽无力、呼吸道分泌物潴留或呼吸衰竭的患者。